有利于降低食物中苯并（a）芘含量的措施是
A. 防止食物霉变
B. 食物加工时减少亚硝酸盐的使用量
C. 将肉熏制后挂于厨房晾晒
D. 使食物不直接接触炭火
E. 在柏油路上晾晒粮食

正确答案：D。使食物不直接接触炭火

解析：本题考查有利于降低食物中苯并（a）芘含量的措施。食物中苯并（a）芘含量较多者主要是烘烤和熏制食品，使食物不直接接触炭火（D对ABCE错）可有利于降低食物中苯并（a）芘含量。